血中维生素B₆的主要存在形式
A. PNP
B. PLP
C. PMP
D. PN
E. PL

正确答案：B。PLP